女，1岁。急起高热、流涎、厌食。查体：见咽部充血，咽腭弓、悬雍垂、软腭等处可见2~4mm大小的疱疹，心肺（-）。最可能的诊断是
A. 咽-结合膜热
B. 猩红热
C. 疱疹性口炎
D. 鹅口疮
E. 疱疹性咽峡炎

正确答案：E。疱疹性咽峡炎

解析：女性幼童患者，急起高热、流涎、厌食。查体：见咽部充血，咽腭弓、悬雍垂、软腭等处可见2~4mm大小的疱疹，心肺（-），综合患者的症状、体征最可能的诊断是疱疹性咽峡炎（E对）。咽结合膜热（A错）以发热、咽炎、结膜炎为特征，临床表现为高热、咽痛、眼部刺痛，有时伴消化道症状，体检发现咽部充血，颈及耳后淋巴结增大。猩红热（B错）的全身症状除有发热、咽痛、头痛、呕吐、杨梅舌、环扣苍白圈、颈部淋巴结肿大外等，皮疹多在发热1～2天出现，且出疹时高热，皮肤弥漫性充血，疹退后伴脱皮。疱疹性口腔炎（C错）起病时高热，先有疱疹，后迅速破溃后形成溃疡，有黄白色纤维素性分泌物覆盖，多个溃疡可融合成不规则的大溃疡，有时累及软腮、舌和咽部，由于疼痛剧烈，患儿可表现拒食、流涎、烦躁，常因拒食啼哭才被发现。鹅口疮（D错）为白念珠菌感染在口腔黏膜表面形成白色斑膜的疾病，口腔黏膜表面覆盖白色乳凝块样小点或小片状物，可逐渐融合成大片，不易擦去，周围无炎症反应，强行剥离后局部黏膜潮红、粗糙，不痛，不流涎，一般不影响吃奶，无全身症状。